治疗黄疸热重于湿证，应首选
A. 茵陈蒿汤
B. 茵陈五苓散
C. 大柴胡汤
D. 犀角散
E. 茵陈术附汤

正确答案：A。茵陈蒿汤

解析：黄疸阳黄热重于湿证治宜重点清热通腑，兼利湿退黄，方选清热力强的茵陈蒿汤（A对）。黄疸阳黄湿重于热证治宜利湿化浊运脾，佐以清热，方选茵陈五苓散合甘露消毒丹（B错）。黄疸阳黄胆腑郁热证治宜疏肝泄热，利胆退黄，方选大柴胡汤（C错）。黄疸阳黄疫毒炽盛证亦称急黄，治宜清热解毒，凉血开窍，方选犀角散（D错）。黄疸阴黄寒湿阻遏证治宜温中化湿，健脾和胃，方选茵陈术附汤（E错）。